与米诺环素合用会影响其吸收导致抗菌作用减弱的药物是
A. 维生素B₆
B. 铝碳酸镁
C. 伏立康唑
D. 阿司匹林
E. 利福平

正确答案：B。铝碳酸镁

解析：本题考查药物的联合应用。铝碳酸镁（B对）组分中含有Ca²⁺、Mg²⁺等，与四环素类同服，可形成难溶性的配位化合物。米诺环素属于四环素，其与铝碳酸镁合用影响吸收。伏立康唑（C错）属于肝药酶抑制剂。阿司匹林（D错）可影响药物排泄。利福平（E错）属于肝药酶诱导剂，其可加快药物的代谢。维生素B₆（A错）在最新版考试指南中未明确要求。